1U维生素A相当于
A. 30㎍维生素A
B. 3㎍维生素A
C. 0.3㎍维生素A
D. 0.03㎍维生素A
E. 0.003㎍维生素A

正确答案：C。0.3㎍维生素A

解析：本题考查维生素计量单位的换算。1U维生素A相当于0.3㎍维生素A（C对）。WHO于1960年规定，每1IU维生素A相当于RE0.344㎍。《中华人民共和国药典临床用药须知》（2015年版）规定，食物中的维生素A含量用视黄醇当量（RE）表示，1U维生素A=0.3㎍维生素A=0.3RE。